患者背痈溃后，脓水稀少，坚肿不消，精神不振，面色无华，脉数无力。治疗应首选
A. 八珍汤
B. 四物汤
C. 透脓散
D. 四君子汤
E. 托里消毒散

正确答案：E。托里消毒散

解析：患者背痈溃后，脓水稀少，坚肿不消，精神不振，面色无华，脉数无力为气血不足证，应消肿，溃脓，生肌，方药：托里消毒散（E对）。气血双补方如八珍汤（A错）。养血方如四物汤（B错）。透脓散用于肿疡已成，毒盛正气不虚，肿疡尚未溃破或溃破后脓出不畅者（C错）。益气方四君子汤（D错）。